预防流行性乙型脑炎疫苗初种年龄
A. 生后2～3天到2个月之内
B. 2个月以上
C. 9个月以上易感儿
D. 3个月以上小儿
E. 8个月以上

正确答案：E。8个月以上

解析：本题考查乙脑疫苗的接种时间。乙型脑炎疫苗包括乙脑减毒活疫苗和乙型脑炎灭活疫苗，二者的初种年龄都是8个月以上（E对ABCD错）。